配合大量饮水，能够促进尿酸排泄的药物有
A. 秋水仙碱
B. 别嘌醇
C. 双氯芬酸
D. 苯溴马隆
E. 丙磺舒

正确答案：D、E。苯溴马隆；丙磺舒

解析：本题考查促进尿酸排泄药。配合大量饮水，能够促进尿酸排泄的药物有苯溴马隆（D对）、丙磺舒（E对）。苯溴马隆和丙磺舒为促进尿酸排泄药，可抑制近端肾小管对尿酸盐的重吸收，使尿酸排出增加，从而降低血尿酸浓度，减少尿酸沉积。亦促进尿酸结晶的重新溶解。秋水仙碱（A错）为抑制粒细胞浸润炎症反应药。别嘌醇（B错）为抑制尿酸生成药。双氯芬酸（C错）为芳基乙酸类非甾体抗炎药。